关于手-足-口病的治疗下列描述错误的是
A. 用淡盐水或0.1％氯己定液漱口，口服维生素B1、维生素B2、维生素C
B. 早期使用利巴韦林静脉滴注
C. 2%～4%碳酸氢钠（小苏打）溶液
D. 用口炎颗粒、板蓝根颗粒或抗病毒颗粒口服
E. 局部用药

正确答案：C。2%～4%碳酸氢钠（小苏打）溶液

解析：手-足-口病的治疗：1)对症治疗：由于手-足-口病的症状较轻，预后良好，主要应注意患儿的休息和护理，给予稀粥、米汤、豆奶及适量冷饮，用淡盐水或0.1％氯己定液漱口，口服维生素B1、维生素B2、维生素C。2)抗病毒治疗：目前尚无特效抗肠道病毒药物。研究显示，干扰素α喷雾或雾化、利巴韦林静脉滴注早期使用可有一定疗效。3)中医中药治疗：本病属中医“湿温”、“时疫”等范畴。病因为湿热疫毒，多因内蕴湿热，外受时邪，留于肺、脾、心三经而成。目前临床上可用口炎颗粒、板蓝根颗粒或抗病毒颗粒（见单纯性疱疹相关内容）口服；特别是托幼单位的群体发病情况下用中草药口服，有较好的疗效。4)局部用药：主要治疗口腔溃疡，如各种糊剂及含片。C项碳酸氢钠溶液为口腔念珠菌病的药物治疗。掌握“手-足-口病”知识点。